下列各项，不属积聚病因的是
A. 情志失调
B. 饮食所伤
C. 感受寒邪
D. 病后所致
E. 跌打损伤

正确答案：E。跌打损伤

解析：情志抑郁，所愿不遂，则气机阻滞，聚而不散，而成聚证，气滞日久，血行不畅，使瘀血内停，脉络受阻，结而成块，以成积证，故情志失调为积聚的病因（A错）。饮食不节，饥饱失宜，损伤脾胃，脾胃失其健运腐熟之职，饮食不能化生水谷精微，反成湿浊痰饮内聚，阻滞气机而成聚证，气滞日久影响血运，形成气滞血瘀，脉络阻滞，而成积证，故饮食所伤为积聚的病因（B错）。寒邪侵袭人体，损伤脾阳，痰湿之邪内生，阻滞气机而成聚证，久病入络，脉涩血凝，结为积块，而成积证，故感受寒邪为积聚的病因（C错）。黄疸日久不退或黄疸虽消退而余邪留恋，使脉络不畅，瘀血内阻；或久疟不愈，气血凝滞，脉络痹阻；或感染血吸虫，虫阻血络，气血运行不畅，血络瘀滞；或虚劳日久，气滞血瘀均可发为积聚，故病后可致积聚，为积聚的病因（D错）。跌打损伤多导致损伤部位的出血或血瘀不能导致积聚（E对）。